献血者为A型血，经交叉配血试验，主侧不凝集而次侧凝集，受血者的血型应为
A. B型
B. AB型
C. A型
D. O型
E. A型或B型

正确答案：B。AB型